早期妊娠的确诊依据是
A. 停经史
B. 早孕反应
C. 尿妊娠试验
D. 黑加征
E. B型超声检查

正确答案：E。B型超声检查

解析：B型超声诊断早期妊娠快速、准确，见到妊娠囊即可确诊，妊娠第6周可以100%确诊（E对）。停经、早孕反应、黑加征均为早孕的临床表现，不具有特异性，不能作为确诊早孕的依据（ABD错）。尿妊娠试验可有假阳性或假阴性，因此应结合临床表现和体征综合分析，才能确诊妊娠（C错）。